慢性肾炎治疗主要目的不包括
A. 防止肾功能进行性恶化
B. 延缓肾功能进行性恶化
C. 改善或缓解临床症状
D. 防治严重并发症
E. 消除尿蛋白及尿红细胞

正确答案：E。消除尿蛋白及尿红细胞

解析：慢性肾炎治疗主要目的包括：防止或延缓肾功能进行性恶化（AB对）、改善或缓解临床症状（C对）及防治心脑血管等严重并发症（D对），具体措施包括消除蛋白尿及尿红细胞（E错，为本题正确答案）等。